确定冠状动脉狭窄部位和严重程度的最佳检查是
A. 心电图
B. 胸部X线
C. 超声心动图
D. 动态心电图
E. 冠状动脉造影

正确答案：E。冠状动脉造影

解析：冠状动脉造影（P222）（E对）是用特殊形状的心导管经股动脉、桡动脉或肱动脉送到主动脉根部，分别插入左、右冠状动脉口，注入少量含碘对比剂，在不同的投射方位下摄影可使左、右冠状动脉及其主要分支得到清楚的显影，从而发现冠状动脉狭窄部位和严重程度。心电图（A错）仅可显示心肌缺血后ST-T段改变的情况。胸部X线（P223）（B错）有助于了解心肺疾病的情况，如有无心脏增大、充血性心力衰竭等。超声心动图（C错）可探测心室的运动情况和左室射血功能。动态心电图（D错）可发现胸痛发作时缺血性ST-T改变，也可检出无痛性心肌缺血。但后四种检查均不能确定冠状动脉狭窄部位和严重程度。